阳虚证的主要临床表现为
A. 形体消瘦
B. 畏寒肢冷
C. 冷汗淋漓
D. 少气懒言
E. 口渴喜冷饮

正确答案：B。畏寒肢冷